队列研究中最重要的偏倚是
A. 住院偏倚
B. 转诊偏倚
C. 回忆偏倚
D. 混杂偏倚
E. 失访偏倚

正确答案：E。失访偏倚

解析：本题考查队列研究的偏倚。在队列研究中，最重要的偏倚是失访偏倚（E对ABCD错）。失访偏倚属于选择偏倚的一种。失访偏倚是指暴露组和对照组的失访人数不等，暴露与结果之间的关系因失访而被歪曲所导致的偏倚。